某地为了解人群高血压发病情况拟进行一次普查，说明调查结果可统计
A. 发病率
B. 罹患率
C. 患病率
D. 累积发病率

正确答案：C。患病率

解析：本题考查普查的特点。普查即全面调查，是指在特定时点或时期内、特定范围内的全部人群（总体）作为研究对象的调查。普查能测的一段时间内全部的病例，包括新发病例和陈旧病例，因此可以获得患病率（C对ABD错）资料。